晚期卵巢癌最常见的症状是
A. 腹痛
B. 阴道出血
C. 腹胀
D. 便秘
E. 发热

正确答案：C。腹胀

解析：早期卵巢癌常无症状。晚期最常见的症状为腹胀（C对）。当肿瘤为功能性病变时，可出现阴道出血（B错）或绝经后出血；当肿瘤向周围组织浸润或压迫，可引起腹痛（A错）；当发生蒂扭转、破裂或邻近器官感染扩散时，可出现发热（E错）；当卵巢癌向肠腔扩散或肿瘤增大占据盆、腹腔时，可引起便秘（D错），因此不是最常见的症状。